下列可在基因克隆技术中生成的物质是
A. 组织或细胞中直接提取的物质
B. 小鼠基因组DNA
C. 酵母基因组DNA
D. 质粒DNA
E. 人类基因组DNA

正确答案：D。质粒DNA

解析：基因克隆技术是指在体外将目的DNA片段与能自主复制的遗传元件（又称载体）连接，形成重组DNA分子，进而在受体细胞中复制、扩增，从而获得单一DNA分子的大量拷贝的一种技术。质粒DNA（D对）是基因克隆最常用的载体，其可在受体细胞中复制、扩增。组织或细胞中直接提取的物质（A错）中包含各种无机物以及蛋白质等其他成分，不能直接用于基因克隆技术。基因组是指一个细胞或者生物体所携带的一套完整的单倍体序列，包括全套基因和间隔序列，常用于物种的鉴定和基因诊断等，因此小鼠基因组DNA（B错）、酵母基因组DNA（C错）及人类基因组DNA（E错）均不可在基因克隆技术中生成。